男，40岁。从3米高处落后昏迷20分钟，查体：P70次/分，BP125/70mmHg，意识清楚，左眶青紫，左鼻孔流出血性液体，神经系统无明显阳性体征。头颅CT发现少量积气。应采取的处理措施是
A. 填塞鼻腔压迫止血
B. 应用抗生素预防性治疗
C. 冲洗鼻腔
D. 开颅手术止血
E. 腰穿释放血性脑脊液

正确答案：B。应用抗生素预防性治疗

解析：患者从高处落下昏迷，左眶青紫（颅骨受伤史），左鼻孔流出血性液体，头颅CT发现少量积气（颅骨骨折的表现），最可能的诊断为颅底骨折。应给予抗生素预防颅内感染治疗（B对），一般不堵塞（A错）或冲洗破口处（C错），不做腰穿（E错）。